正常腮腺组织内淋巴结的髓质内出现导管以及腺泡样结构占
A. 1%～5%
B. 5%～10%
C. 5%～15%
D. 10%～15%
E. 15%～20%

正确答案：B。5%～10%

解析：正常腮腺组织内，经常出现小的淋巴结。其中，5%～10%淋巴结的髓质内出现导管以及腺泡样结构；有时淋巴结呈壳样包绕在腮腺腺叶外围。掌握“唾液腺组织学特点”知识点。